商陆中含有的商陆皂苷，其结构类型是
A. 三萜皂苷
B. 甾体皂苷
C. 环烯醚萜苷
D. 强心苷
E. 黄酮苷

正确答案：A。三萜皂苷

解析：本题考查的是商陆皂苷的结构类型。商陆中含有的商陆皂苷，其结构类型是三萜皂苷（A对）。商陆的化学成分主要包括三萜及其皂苷类，其中包括商陆皂苷等。《中国药典》以商陆皂苷甲（商陆皂苷A）为指标成分进行含量测定，含量不得少于0.15%。三萜皂苷由三萜皂苷元和糖组成，苷元为三萜类化合物，其基本骨架由6个异戊二烯单位组成。含三萜皂苷的常用中药有人参、三七、甘草、黄芪、合欢皮、商陆和柴胡等。甾体皂苷（B错）与三萜皂苷相似，由甾体皂苷元与糖组成。含甾体皂苷的常用中药主要有麦冬、知母等。环烯醚萜苷（C错）的苷元结构特点为1位多连羟基，并多成苷；常有双键存在。含有环烯醚萜苷的常用中药有栀子、鸡屎藤、地黄等。强心苷（D错）是存在于生物界中的一类对心脏有显著生理活性的甾体苷类。主要分布于夹竹桃科、玄参科、百合科、萝藦科、十字花科、毛茛科和桑科等。含强心苷类化合物的常用中药有香加皮、罗布麻叶等。黄酮苷（E错）：天然黄酮类化合物多以苷类形式存在，并且由于糖的种类、数量、连接方式、数量、连接位置及连接方式不同，可以组成各种各样的黄酮苷类。含有黄酮苷的常用中药有黄芩、葛根、银杏叶、槐花、陈皮、满山红等。